酸雨的主要前体物质是
A. CO₂
B. CO
C. O₃
D. SO₂
E. PAH

正确答案：D。SO₂

解析：本题考查酸雨的主要前体物质。酸雨的形成受多种因素影响，其主要前体物质是SO₂和NOx，其中SO₂（D对ABCE错）对全球酸沉降的贡献率为60%～70%。